女性，26岁，右上后牙龈肿痛1周，口服消炎药治疗无效。检查：右上第一磨牙牙体颊侧牙周脓肿形成，叩痛（+），冷测反应同对照牙，牙周袋8mm，应急处理应是
A. 局部麻醉下开髓
B. 龈上洁治
C. 龈下刮治
D. 脓肿切开引流
E. 全身药物治疗

正确答案：D。脓肿切开引流

解析：患者表现为牙周脓肿，且已有1周时间，但病变局限，此时的脓肿应已有较多脓液，处理原则应是引流，由于病变局限，不需用全身药物治疗。掌握“牙周脓肿”知识点。